增加胰岛素敏感性的降血糖药物是
A. 马来酸罗格列酮
B. 瑞格列奈
C. 格列本脲
D. 甲苯磺丁脲
E. 阿卡波糖

正确答案：A。马来酸罗格列酮

解析：本题考查胰岛素增敏剂。马来酸罗格列酮（A对）能增加胰岛素敏感性。马来酸罗格列酮属于噻唑烷二酮类胰岛素增敏剂。瑞格列奈（B错）、格列本脲（C错）、甲苯磺丁脲（D错）均为胰岛素分泌促进剂。阿卡波糖（E错）是α-葡萄糖苷酶抑制剂。